主要通过空气传播的疾病是
A. 结核杆菌
B. 艾滋病
C. 梅毒
D. 病毒性肝炎
E. 疱疹

正确答案：A。结核杆菌

解析：本题考查口腔医疗保健中的感染。主要通过空气传播的疾病是结核杆菌（A对）。1.结核杆菌存在于痰中，通过咳嗽、打喷嚏、大声说话等方式经鼻腔和口腔喷出体外，在空气中形成气雾（或称为飞沫），较大的飞沫很快落在地面，而较小的飞沫很快蒸发成为含有结核菌的“微滴核”，并长时间悬浮在空气中。如果空气不流通，含菌的“微滴核”被健康人吸入肺泡，可引起感染。2.艾滋病（B错）在口腔临床的传播方式：艾滋病可通过性接触、血液或血液制品以及母婴传播。在口腔领域主要有两种：①直接传播（通过接触患者的血液、唾液）；②间接传播（主要通过污染的器械、飞溅到皮肤或黏膜上的血液或唾液以及含有微生物的气雾）。3.梅毒（C错）是感染梅毒螺旋体导致的疾病。梅毒螺旋体在体外生存时间短，容易为消毒剂所杀灭。梅毒分为获得性与先天性两类。获得性梅毒有三期，初期的口腔病变为唇部等硬结、溃疡；二期为“黏膜斑”；晚期常为腭部坏死，溃疡甚至穿孔。先天性梅毒可表现为梅毒牙异常特征等。在艾滋病患者中梅毒很常见。原发的硬疳和继发的皮肤病损都可成为感染源，接触感染者的血液可引起疾病传染。4.乙型（病毒性）肝炎（简称乙肝）（D错）由乙肝病毒（HBV）感染引起，是一种传播广泛、严重危害人类健康的传染病，是导致急慢性肝炎、肝硬化和肝癌的主要原因。乙肝病毒在口腔临床中的传播方式主要是接触传播，通过直接接触患者的血液、唾液、龈沟液以及接触被污染的环境都可能感染疾病。5.疱疹（E错）经接触传播。